WHO在哪一年提出了卫生服务综合评价模式
A. 1974
B. 1975
C. 1976
D. 1980
E. 1985

正确答案：C。1976

解析：本题考查WHO提出卫生服务综合评价模式的时间。WHO通过对英国、美国、加拿大、荷兰、芬兰、阿根廷、前南斯拉夫等7个国家共12个地区1500万居民近10年的卫生服务抽样调查，于1976年（C对ABDE错）提出了卫生服务综合评价模式。